下列哪种情况下的体温升高属于过热？
A. 妇女月经前
B. 妇女妊娠期
C. 剧烈运动后
D. 流行性感期
E. 中暑

正确答案：E。中暑

解析：中暑（E对）是由于散热障碍引起的非调节性体温升高，属于过热。流行性感冒（D错）是由于致热原引起的调节性体温升高，属于发热。妇女月经前（A错）、妇女月经期（B错）和剧烈运动后（C错）是生理情况下的体温升高，属于生理性反应。